医患之间要做到真诚相处，最主要的是
A. 关系和谐
B. 尽职尽责
C. 平等相待
D. 互相尊重
E. 互相信任

正确答案：E。互相信任

解析：医患之间要做到真诚相处，最主要的是互相信任。为了战胜疾病，恢复健康，医患之间像同事一样，彼此平等，相互尊重，相互信任，真诚相待，共同合作，为了一致的目标共同努力，进而形成和谐的合作关系（E对）。